毒理学试验中溶剂的选择原则不包括
A. 受试物溶解后稳定
B. 无特殊气味或刺激性
C. 与受试物不发生反应
D. 不改变受试物的理化性质及生物学活性
E. 本身毒性较低

正确答案：E。本身毒性较低